小儿出生后正常情况下造血器官主要是
A. 卵黄囊
B. 中胚叶
C. 肝脏
D. 骨髓
E. 脾脏

正确答案：D。骨髓

解析：小儿出生后正常情况下造血器官主要是骨髓（D对）。卵黄囊、中胚叶是胚胎期时的造血方式，并不是出生后的造血方式（AB错）。在正常情况下，骨髓外造血极少。出生后，当发生感染性贫血或溶血性贫血等造血需要增加时，肝脏和脾脏才会造血（CE错）。